等渗性缺水的临床表现为
A. 短期内体液的丧失达体重3％时有休克
B. 休克常伴有代谢性酸中毒
C. 明显口渴
D. 化验检查见血清Na⁺降低
E. 化验检查见尿比重在1.010以下

正确答案：B。休克常伴有代谢性酸中毒

解析：等渗性缺水患者，若在短期内体液丧失量达体重的5%时，病人就会出现脉搏细速、肢端湿冷、血压不稳定或下降等血容量不足之症状，即休克。丢失体重3%的体液并不会出现休克（A错）。休克时，由于微循环障碍，酸性代谢物大量产生和堆积，常伴有代谢性酸中毒（B对）。等渗性缺水时，血清Na⁺浓度正常（D错），而口渴中枢感受的是血清Na⁺浓度，因此等渗性和低渗性缺水患者均无口渴（C错），只有高渗性患者有口渴。等渗性缺水患者，醛固酮分泌增加，促进肾远曲小管对钠的重吸收，随钠一同被重吸收的水量也增加，因此等渗性缺水患者尿量减少、尿比重（成人正常范围为1.015～1.025）增加。尿比重在1.010以下（E错）为低渗性缺水的特点。